细胞水平检测抗体形成能力的方法是
A. 抗人球蛋白（Coomb's）试验
B. E花环试验
C. 凝集反应
D. 淋巴细胞转化试验
E. 溶血空斑试验

正确答案：E。溶血空斑试验